乙型肝炎是
A. 血液传播
B. 飞沫传播
C. 唾液传播
D. 粪口传播
E. 蚊虫传播

正确答案：A。血液传播

解析：乙型肝炎属于病毒感染性疾病，可通过以下途径进行传播：①血液传播（A对）：通过输血或血制品、使用污染的注射器或针刺、拔牙、手术、血液透析、器官移植等，原因是血液中HBV含量很高，微量的污染血进入人体即可造成感染。②母婴垂直传播：妊娠期主要通过胎盘轻微剥离，分娩时婴儿破损的皮肤、黏膜接触母血、羊水或阴道分泌物而传染，分娩后通过哺乳及密切接触而传染。③日常生活密切接触传播：HBV可以通过日常生活密切接触传播给家庭成员，例如共用牙刷、剃刀，易感者的皮肤、黏膜微小破损接触带有HBV的微量血液及体液等。④性接触传播：精液、阴道分泌物中含有HBV，无防护的性接触可以传播HBV。飞沫传播（B错）是空气传播的一种方式，常见于流行性脑脊髓膜炎、猩红热、百日咳、流感、麻疹等传染性疾病，不属于乙型肝炎的传播途径。唾液传播（C错）常见于上呼吸道感染、结核病等传染性疾病，不属于乙型肝炎的传播途径。粪口传播（D错）常见于甲型肝炎、肠道疾病、手足口病等传染性疾病，不属于乙型肝炎的传播途径。蚊虫传播（E错）常见于疟疾、登革热等传染性疾病，不属于乙型肝炎的传播途径。